男性，76岁。有阻塞性肺气肿史，咳嗽，咳脓痰，伴气急，加重2周，今晨起神志恍惚。体检：嗜睡，口唇青紫，两肺湿啰音。心率116次/分，律齐，血压180/100mmHg，神经系统检查未见异常。明确诊断，还需做哪项检查
A. 脑CT
B. 心电图
C. 动脉血气分析
D. 脑电图
E. 肾动脉造影

正确答案：C。动脉血气分析